关于中药剂型选择及其与疗效关系的说法，错误的是
A. 中药药性是中药剂型选择的重要依据
B. 不同剂型的药物其作用速率可能不同
C. 药物不会因剂型不同而发生作用性质的变化
D. 急症用药宜选用注射剂气雾剂或舌下片等剂型
E. 不同剂型的药物其安全性可能不同

正确答案：C。药物不会因剂型不同而发生作用性质的变化

解析：本题考查的是剂型与疗效的关系。药物可能会因剂型不同而发生作用性质的变化（C错，为本题正确答案）。剂型与疗效关系：1.剂型可改变药物的作用性质：多数药物改变给药途径和剂型后，药物的性质不会改变，但有些药物会因剂型或给药途径的改变而改变药物的作用性质，如硫酸镁口服制剂为泻下制剂，而静脉注射则为镇静、解痉制剂。2.剂型可改变药物的作用速率：同一种药物因剂型、给药方式不同，会出现不同的作用速率（B对），通常不同剂型、不同给药方式的药物起效快慢顺序为：静脉注射＞吸入给药＞肌内注射＞皮下注射＞直肠或舌下给药＞口服液体制剂＞口服固体制剂＞皮肤给药。3.剂型可改变药物的安全性（E对）：中药制剂的使用安全风险的高低顺序通常为静脉注射＞肌内注射＞口服给药＞外用给药，因此，能够选择口服给药剂型时，一般不选择注射给药；能够选择肌内注射给药剂型时，一般不选择静脉注射给药剂型。此外，还可利用制备成缓控释剂型以控制药物的释放速率，实现长效给药目的。利用靶向给药技术实现药物的靶向治疗目的。中药剂型的选择应满足药物性性质的需要：中药药性是剂型选择的重要依据（A对）。剂型选择需要考虑中药传统药性，包括中药的四气五味、升降沉浮、有毒无毒、性味归经等，还要研究中药制剂所含活性成分的溶解性、稳定性和刺激性以及生物药剂学和药代动力学性质，综合选择适宜剂型。急症患者，要求奏效迅速，宜选用注射剂、气雾剂、舌下片、滴丸等速效剂型（D对）；而慢性病患者，用药宜缓和、持久，应选用丸剂、片剂、膏药及长效缓释制剂等；皮肤疾患一般可用软膏剂、涂膜剂、洗剂、搽剂等剂型；而某些腔道病变，可选用栓剂、条线剂等。